冠内固位形不包括
A. 鸠尾形
B. 钉洞形
C. 箱状形
D. 旋转形
E. 沟形

正确答案：D。旋转形

解析：本题考查固定桥的设计。冠内固位体：包括两面嵌体、三面嵌体、多面嵌体及针型固位高嵌体等，则箱状形（C对）、钉洞固位形（B对）、沟固位形（E对）、洞固位形（其中有鸠尾扣（A对）和洞缘斜面），而旋转形（D错，为本题正确答案）不在此类固位体的固位形制备之中。